关于中央性颌骨癌临床特点的叙述中，不正确的是
A. 主要来自牙胚成釉上皮的剩余细胞
B. 好发于上颌骨
C. 多伴下唇麻木
D. 患者早期无自觉症状
E. X线表现有不规则虫蚀状破坏

正确答案：B。好发于上颌骨

解析：本题考查中央性颌骨癌及上颌窦癌。中央性颌骨癌好发于下颌骨（B错，为本题正确答案），特别是下颌磨牙区。